男，70岁，直肠指诊前列腺有一硬结，血清PSA20ng/ml。可能的诊断是
A. 前列腺增生
B. 前列腺癌
C. 结肠癌
D. 前列腺结石
E. 纤维瘢痕

正确答案：B。前列腺癌

解析：患者直肠指诊有硬结，PSA大于20ng/ml（PSA是前列腺癌重要的血清标志物，正常参考值为0~4ng/ml），故考虑患者可能为前列腺癌（B对）。